面部的人中是由
A. 两个额鼻突中央部分联合
B. 两个球状突中央部分联合
C. 两个侧鼻突中央部分联合
D. 两个上颌突中央部分联合
E. 两个下颌突中央部分联合

正确答案：B。两个球状突中央部分联合

解析：胚胎第6周，两个球状突中央部分联合，形成人中。掌握“面部的发育”知识点。